春温，热伤真阴，心火亢盛病证，其治疗处方是
A. 阿胶黄芩汤
B. 黄连阿胶汤
C. 黄芩汤
D. 连梅汤
E. 清营汤

正确答案：B。黄连阿胶汤

解析：吴鞠通《温病条辨》所言“少阴温病，真阴欲竭，壮火复炽，心中烦，不得卧者，黄连阿胶汤主之”。春温后期，邪热久羁而耗伤肾阴，水亏火旺，水火不能相济，火愈亢而阴愈伤，阴愈亏而火愈炽。治当以清热降火，育阴安神，方选黄连阿胶汤（B对）。方中以黄连、黄芩苦寒清热，泻心火，坚真阴；鸡子黄交通心肾，养心而滋肾，安中焦，补精血；阿胶、白芍滋肝肾，养真阴，抑亢阳。